鼻窦炎口服液的功能是
A. 芳香化浊通鼻窍
B. 祛风宣肺，清热解毒
C. 祛风，清热解毒
D. 散风利胆，通窍
E. 疏散风热，清热利湿，宣通鼻窍

正确答案：E。疏散风热，清热利湿，宣通鼻窍

解析：本题考查的是鼻窦炎口服液的功能。鼻窦炎口服液的功能是疏散风热，清热利湿，宣通鼻窍（E对）。鼻窦炎口服液【功能】疏散风热，清热利湿，宣通鼻窍。霍胆丸【功能】芳香化浊，清热通窍（A错）。鼻炎片【功能】清热解毒，宣肺通窍（B错），消肿止痛。散风通窍滴丸【功能】清热祛风，散寒通窍（D错）。